男，低热，体重减轻5kg，右下腹可疑肿块，回盲部跳跃征，盲肠及结肠短缩。考虑为什么病
A. 肠结核
B. 克罗恩病
C. 溃疡性结肠炎
D. 结肠癌
E. 肠易激综合征

正确答案：A。肠结核

解析：肠结核临床表现：腹痛多位于右下腹或脐周，间歇发作，餐后加重，有长期不规则低热、盗汗、消瘦、贫血和乏力；腹部肿块多位于右下腹。质中、较固定、轻中度压痛；以及大便习惯改变。X线钡剂检查：跳跃征、溃疡、肠管变形和肠腔狭窄等征象（A对）。克罗恩病起病大多隐匿、缓慢，从发病早期症状到确诊需要数月至数年。内镜检查：阶段性、非对称性的各种黏膜炎症、纵行溃疡、鹅卵石样外观，病变成阶段性分布（B错）。X线钡剂灌肠，1、粘膜粗乱和颗粒样改变。2、多发性浅溃疡，表现为管壁边缘毛糙，呈毛刺状或锯齿状以及小龛影、卵圆形充盈缺损（C错）。结肠癌钡剂灌肠可发现结肠充盈缺损、肠腔狭窄、黏膜皱壁破坏等征象，显示癌肿部位和范围（D错）。肠易激综合症最主要的临床表现是腹痛、排便习惯和粪便性状的改变，电子肠镜检查无异常（E错）。